合成IMP和UMP的共同原料是
A. 天冬酰胺
B. 天冬氨酸
C. 甘氨酸
D. 甲硫氨酸
E. 一碳单位

正确答案：B。天冬氨酸